糖尿病人体温38℃，围手术期处理措施中不正确的是
A. 术前使用长效胰岛素者，术后要继续使用
B. 术前即给与抗生素
C. 将血糖稳定在轻度升高的状态方可进行大手术
D. 术后要注意胃瘫
E. 术后要注意足部检查

正确答案：A。术前使用长效胰岛素者，术后要继续使用

解析：糖尿病病人手术耐受力差，术前应控制血糖，将血糖稳定于轻度升高状态（5.6～11.2mmol／L）方可进行手术（C对）。糖尿病人术后需要禁食或做饮食调整，应用长效胰岛素不便于控制血糖水平，故术前使用长效胰岛素者，术后应改为短效胰岛素（A错，为本题正确答案）。糖尿病患者手术感染并发症多且后果严重，故若术前发热应立即给与抗生素（B对）以及时控制感染。糖尿病患者晚期常伴神经系统并发症，若自主神经病变则可能出现胃排空延迟，故术后要注意胃瘫（D对）；若下肢远端神经异常则可能出现糖尿病足，故术后要注意足部检查（E对），检查有无皮肤破损感染。